患者身目俱黄，黄色晦暗，腹胀纳少，神疲畏寒，大便不实，口淡不渴，舌淡苔腻，脉濡缓。诊断为黄疸，其证候是
A. 阴黄
B. 急黄
C. 阳黄湿热并重
D. 阳黄热重于湿
E. 阳黄湿重于热

正确答案：A。阴黄

解析：题中患者以身目俱黄为主症，故诊断为黄疸。由于寒湿阻滞脾胃，阳气不宣，胆汁外泄，因寒湿为阴邪，故黄色晦暗；腹胀纳少，大便不实，口淡不渴，皆为湿困中土，脾阳不振，运化功能失常的表现；神疲畏寒，为阳气已虚，气虚不足；舌淡苔腻，脉濡缓，系阳虚湿浊不化，寒湿困于阴分之象。故辩证为阴黄（A对）。急黄可见发病急骤，黄疸迅速加深，其色如金，或见衄血、便血等症，无黄色晦暗，或如烟熏，神疲畏寒等症（B错）。阳黄湿热并重可见黄色鲜明而题中患者黄色晦暗（C错）。阳黄热重于湿可见身目惧黄，黄色鲜明，发热口渴，伴口苦而干等症，而题中患者黄色晦暗，神疲畏寒（D错）。阳黄湿重于热可见身目惧黄，黄色不及前者鲜明，头重身困，胸脘痞满等症，而题中患者黄色晦暗，神疲畏寒（E错）。